挥发油中主要含有的萜类化合物是
A. 单萜
B. 倍半萜
C. 萜
D. 二倍半萜
E. 三萜

正确答案：A、B。单萜；倍半萜

解析：本题考查的是挥发油的组成成分。挥发油中主要含有的萜类化合物是单萜（A对）与倍半萜（B对）。挥发油的组成成分主要有四类。1.萜（C错）类化合物：萜类在挥发油的组成成分中所占比例最大，主要是单萜、倍半萜及其含氧衍生物，其含氧衍生物多是该油中生物活性较强或具芳香气味的主要成分。如薄荷油含薄荷醇约80%；山苍子油含柠檬醛80%等。2.芳香族化合物：挥发油中的芳香族化合物多为小分子的苯丙素类衍生物，在挥发油中所占比例次于萜类，具有C₆-C₃骨架，且多为酚性化合物或其酯类，如桂皮中有解热镇痛作用的桂皮醛。还有些是萜源化合物，如百里香酚；有些是具有C₆-C₂或C₆-C₁骨架的化合物，如花椒油素等。3.脂肪族化合物：挥发油中的脂肪族化合物多为一些小分子化合物，包括醇、醛、酮、羧酸类等，其含量和作用一般不如萜类和芳香族化合物。如陈皮中的正壬醇、人参挥发油中的人参炔醇、鱼腥草挥发油中的癸酰乙醛即鱼腥草素及甲基正壬酮等都属挥发油中的脂肪族化合物。4.其他类化合物：除以上三类化合物外，有些中药经过水蒸气蒸馏能分解出挥发性成分，如芥子油、原白头翁素、大蒜油等，也常称之为“挥发油”。这些成分在植物体内多数以苷的形式存在，经酶解后的苷元随水蒸气一同馏出而成油，如黑芥子油是芥子苷经芥子酶水解后产生的异硫氰酸烯丙酯；挥发杏仁油是苦杏仁苷水解后产生的苯甲醛；原白头翁素是毛茛苷水解后产生的化合物；大蒜油则是大蒜中大蒜氨酸经酶水解后产生的含大蒜辣素等的挥发性油状物。二倍半萜（D错）：主要以海绵、植物病菌、昆虫代谢物等形式存在。三萜（E错）：多数三萜类化合物是一类基本母核由30个碳原子组成的萜类化合物，其结构根据异戊二烯定则可视为六个异戊二烯单位聚合而成，也是一类重要的中药化学成分。含三萜类化合物的中药有人参、三七、甘草、黄芪、合欢皮、商陆、柴胡等。